理想牙刷具有的特点中，除外
A. 吸水性好
B. 回弹力好
C. 易洗涤和干燥
D. 刷毛顶端磨圆钝
E. 牙刷柄具有防滑设计

正确答案：A。吸水性好

解析：理想牙刷吸水性差、细软、回弹力好、易洗涤和干燥、无味。掌握“自我口腔保健方法”知识点。